用亚硝酸钠滴定法测定药物的含量，以下叙述正确的有
A. 基于药物结构中的芳伯氨基
B. 以冰醋酸为溶剂
C. 加入溴化钾作为催化剂
D. 用永停法指示终点
E. 用0.1mol/L亚硝酸钠滴定液滴定

正确答案：A、C、D、E。基于药物结构中的芳伯氨基；加入溴化钾作为催化剂；用永停法指示终点；用0.1mol/L亚硝酸钠滴定液滴定

解析：本题考查亚硝酸钠滴定法。亚硝酸钠滴定法是亚硝酸钠在盐酸存在条件下与具有芳伯氨基化合物（A对）发生重氮化反应，定量生成重氮盐，用0.1mol/L亚硝酸钠滴定液（E对B错）滴定。加入溴化钾（C对）作为催化剂，可加快重氮化反应速度。亚硝酸钠滴定法指示终点的方法有：电位法、永停滴定法、内指示剂法和外指示剂法，《中国药典》中亚硝酸钠用永停法指示终点（D对）。